两胁作痛，头痛目眩，月经不调，乳房作胀，神疲食少，脉弦而虚者治宜选用
A. 一贯煎
B. 痛泻要方
C. 四逆散
D. 柴胡疏肝散
E. 逍遥散

正确答案：E。逍遥散

解析：逍遥散可疏肝解郁，养血健脾，主治肝郁血虚脾弱证。肝郁血虚，故可见两胁作痛，脉弦而虚；脾失健运，故可见神疲食少。肝郁血虚，脾失健运，当疏肝解郁，养血健脾，宜选用逍遥散（E对）。一贯煎可滋阴疏肝，主治肝肾阴虚，肝气郁滞证（A错）。痛泻药方可补脾柔肝，祛湿止泻，主治脾虚肝郁之痛泻（B错）。四逆散可透邪解郁，疏肝理脾，主治阳郁厥逆证或肝脾气郁证（C错）。柴胡疏肝散具有疏肝理气，活血止痛的功效，主治肝气郁滞证（D错）。